女性，35岁。诉下唇左侧疼痛破溃4天，影响进食。同样病史每年发作3～6次。口腔检查：下唇左侧黏膜可见一个直径4mm的溃疡，周边红，溃疡表面有黄色假膜，溃疡底部微凹陷，触痛明显。临床可诊断为
A. 复发性轻型阿弗他溃疡
B. 复发性疱疹样口炎
C. 复发性重型阿弗他溃疡
D. 多形性红斑
E. 疱疹性口炎

正确答案：A。复发性轻型阿弗他溃疡

解析：本题考查复发性阿氟他溃疡的临床表现。女性，35岁。诉下唇左侧疼痛破溃4天，影响进食。同样病史每年发作3～6次。口腔检查：下唇左侧黏膜可见一个直径4mm的溃疡，周边红，溃疡表面有黄色假膜，溃疡底部微凹陷，触痛明显。临床可诊断为复发性轻型阿弗他溃疡（A对）。根据患者发病情况（同样病史每年发作3～6次）以及局部表现可诊断为复发性轻型阿弗他溃疡，多数复发性阿弗他溃疡患者发病时均为此型，该型是反复发作的圆形或椭圆形溃疡，具有黄红凹痛的特征，即溃疡表面覆盖黄色假膜、周围有红晕带、中央有凹陷、疼痛明显，有周期性、复发性、自愈性。复发性疱疹样口炎（B错）、疱疹性口炎（E错）的损害表现为有多个成簇的疱，而该患者未出现疱。复发性重型阿弗他溃疡（C错）的溃疡大而深，直径可大于10mm，而本题中溃疡的直径仅为4mm。多形性红斑（D错）口腔黏膜广泛充血、发红、水肿，并有大面积糜烂，皮肤可见多种病损如红斑、丘疹，与患者的病变特征不符。